下列疾病中，不属于心身疾病的是
A. 原发性高血压
B. 抑郁症
C. 癌症
D. 冠心病
E. 肾衰竭

正确答案：B。抑郁症

解析：几种常见的心身疾病：原发性高血压、冠心病、癌症。原发性高血压是以慢性血压升高为特征的临床综合征。高血压导致冠心病、脑卒中、肾衰竭等并发症。抑郁症属于精神疾病。掌握“心身疾病”知识点。